不产毒素的白喉棒状杆菌被β-棒状杆菌噬菌体感染时则变成产毒白喉棒状杆菌，是发生
A. 转化
B. 转导
C. 溶原性转换
D. 接合
E. 原生质体融合

正确答案：C。溶原性转换